关于结肠损伤的描述，不正确的是
A. 结肠损伤发生率低于小肠损伤
B. 结肠内细菌多，一旦损伤继发腹腔感染较严重
C. 部分结肠位居腹膜后，损伤常导致腹膜后感染
D. 结肠内细菌多，一旦损伤腹膜炎均很早表现出来
E. 腹部闭合损伤中，结肠损伤易漏诊

正确答案：D。结肠内细菌多，一旦损伤腹膜炎均很早表现出来

解析：结肠的主要功能是吸收水分和无机盐，不分泌消化液。由于结肠内容物液体成分少而细菌含量多，因此结肠损伤后所致腹膜炎出现得较晚（D错，为本题正确答案），继发腹腔感染较严重（B对）；而且部分结肠居于腹膜后，损伤后容易漏诊（E对），常导致腹膜后感染（C对）。结肠损伤发生率仅次于小肠损伤（A对）。